患者，女，44岁，半年前诊断为支气管哮喘，间断口服沙丁胺醇4mg，tid治疗。没有规律用药治疗。今日，因秋冬季节交替，出现明显喘憋，话不成句，被紧急送往医院。该患者支气管哮喘的长期维持治疗宜选用
A. 沙丁胺醇片
B. 福莫特罗吸入剂
C. 沙丁胺醇气雾剂
D. 沙美特罗氟替卡松粉吸入剂
E. 茶碱片

正确答案：D。沙美特罗氟替卡松粉吸入剂

解析：本题考查支气管哮喘用药。该患者支气管哮喘的长期维持治疗宜选用沙美特罗氟替卡松粉吸入剂（D对）。吸入型糖皮质激素是哮喘长期治疗的首选药物，联合制剂沙美特罗氟替卡松粉吸入剂是目前常用的哮喘控制方案。沙丁胺醇片（A错）和沙丁胺醇气雾剂（C错）为短效β₂受体激动剂，是治疗哮喘急性发作的首选药物。福莫特罗吸入剂（B错）为长效β₂受体激动剂，不能单独用于哮喘治疗。茶碱片（E错）为茶碱类药物。